慢性龈炎的病理变化中纤维增生型不包括
A. 上皮下纤维结缔组织增生成束
B. 束间可见淋巴细胞及浆细胞浸润
C. 毛细血管增生不明显
D. 牙龈的纤维结缔组织水肿明显
E. 炎症成分比水肿型为少

正确答案：D。牙龈的纤维结缔组织水肿明显

解析：本题考查牙龈疾病。慢性龈炎的病理变化中纤维增生型不包括牙龈的纤维结缔组织水肿明显（D错，为本题正确答案）。 镜下见慢性龈炎主要在牙龈的龈沟壁处有炎症细胞浸润，在沟内上皮的下方可见中性粒细胞浸润，其下方为大量的淋巴细胞（主要为T淋巴细胞）。炎症细胞浸润区域的胶原纤维大多变性或丧失。纤维增生型：上皮下纤维结缔组织增生成束，束间可见淋巴细胞及浆细胞浸润，毛细血管增生不明显，其炎症成分比水肿型为少。掌握“牙龈疾病”知识点。